典型化脓性脑膜炎脑脊液外观特点为
A. 清亮
B. 血性，有时可见血凝块
C. 外观混浊，压力增高
D. 混浊但压力不高
E. 毛玻璃样

正确答案：C。外观混浊，压力增高

解析：典型化脓性脑膜炎脑脊液外观特点为外观混浊，压力增高。化脓性脑膜炎以蛛网膜、软脑膜和表层脑组织为主的炎症反应，表现为广泛的血管充血、大量的中性粒细胞浸润和纤维蛋白渗出、伴有弥漫性脑水肿（C对）。脑脊液清亮为正常脑脊液（A错）。新出血时进则呈红色或血性（B错）。细菌性脑膜炎时，脑脊液可呈乳白色或绿色混浊。感染时脑脊液混浊但压力不高（D错）。结核性脑膜炎时，脑脊液内的白细胞中度增多，可呈轻度毛玻璃样混浊（E错）。